为了防止食盐结块，我国规定亚铁氰化钾在盐和代盐制品中最大使用量为
A. 0.01g/kg
B. 0.02g/kg
C. 0.05g/kg
D. 0.08g/kg
E. 0.10g/kg

正确答案：A。0.01g/kg

解析：本题考查食用盐的卫生管理。为了防止食用盐结块，生产过程中常在盐中加入微量的抗结剂，我国规定亚铁氰化钾在盐和代盐制品中最大使用量为0.01g/kg（A对BCDE错）。